中性粒细胞的主要功能是
A. 产生抗体
B. 参与止血
C. 释放细胞毒素
D. 吞噬异物
E. 释放组胺

正确答案：D。吞噬异物